与维生素D中毒无直接关系的表现是
A. 钙在心脏、血管等软组织内沉积
B. 口渴、烦躁
C. 恶心、呕吐
D. 胆囊炎
E. 关节疼痛

正确答案：D。胆囊炎